性传播疾病最常见的传播途径是
A. 血液传播
B. 性行为
C. 接触传播
D. 胎盘传播
E. 经产道传播

正确答案：B。性行为